颈动脉搏动，多见于
A. 二尖瓣关闭不全
B. 主动脉瓣关闭不全
C. 三尖瓣关闭不全
D. 肺动脉瓣关闭不全
E. 二尖瓣狭窄

正确答案：B。主动脉瓣关闭不全

解析：颈动脉搏动，多见于主动脉瓣关闭不全患者（B对）。二尖瓣关闭不全者心尖搏动强，心尖部呈抬举样搏动（A错）。三尖瓣关闭不全者可见颈静脉搏动和肝脏扩张性搏动（C错）。肺动脉瓣关闭不全可扪及扩大的肺动脉收缩期搏动（D错）。二尖瓣狭窄心尖搏动可向左移位，心尖区常有舒张期震颤（E错）。